截根术后最可能发生的并发症是
A. 牙髓坏死
B. 余留牙根折
C. 牙周脓肿
D. 牙龈退缩
E. 牙根吸收

正确答案：B。余留牙根折

解析：本题考查截根术后最可能发生的并发症。截根术后患牙支持作用减少，受力方向改变，原有的轴向力变为侧向力，余留牙根负担加重而容易发生根折（B对）。截根术前应做根管治疗，术后患牙已经是无髓牙，所以不可能存在牙髓坏死（A错）。截根术会把根分叉深部及拔牙窝内的病变组织刮净，牙周炎症程度会明显改善，一般术后不会出现牙周脓肿（C错），牙龈退缩（D错）及牙根吸收（E错）等症状。